能抑制DNA病毒的药物是
A. 四环素
B. 利巴韦林
C. 妥布霉素
D. 氟康唑
E. 林可霉素

正确答案：B。利巴韦林

解析：四环素类（A错）药物（包括四环素）首选治疗立克次体感染、支原体感染、衣原体感染以及某些螺旋体感染。利巴韦林（B对）又名病毒唑，是人工合成的鸟嘌呤类似物，为广谱抗病毒药，对多种RNA和DNA病毒有抑制作用。妥布霉素（C错）适合治疗铜绿假单胞菌所致的各种感染，通常应与能抗铜绿假单胞菌的青霉素类或头孢菌素类药物合用。氟康唑（D错）主要用于念珠菌、隐球菌等真菌感染。林可霉素（E错）可用于葡萄球菌属引起的轻中度感染。